阿司匹林红外吸收光谱中主要特征峰的波数是：苯环vC=C
A. 3300～2300cm⁻¹
B. 1760～1695cm⁻¹
C. 1610～1580cm⁻¹
D. 1310～1190cm⁻¹
E. 750cm⁻¹

正确答案：C。1610～1580cm⁻¹